药物与适宜基质制成的具有一定形状的供人体腔道内给药的固体制剂称为
A. 微囊
B. 滴丸
C. 栓剂
D. 微丸
E. 软胶囊

正确答案：C。栓剂

解析：本题考查栓剂。栓剂（C对）指药物与适宜基质制成的具有一定形状供腔道给药的固体外用制剂；微囊（A错）是将固体或液体药物利用高分子物质或共聚物包裹制成的微型胶囊；滴丸（B错）指固体或液体药物与适当物质（一般称为基质）加热熔化混匀后，滴入不相混溶的冷凝液中、收缩冷凝而制成的小丸状制剂；微丸（D错）指药物粉末和辅料构成的直径小于2.5mm的圆球状实体；软胶囊（E错）指将液体药物或液果体药物经处理密封于软质囊材中而制成的一种胶囊剂。